可摘局部义齿铸造金属基托的厚度约为
A. 0.5mm
B. 1mm
C. 1.5mm
D. 2mm
E. 2.5mm

正确答案：A。0.5mm

解析：本题考查局部义齿人工牙及基托。铸造金属基托的厚度约0.5mm（A对），边缘可厚至1mm，并圆钝。